孕妇对能量和各种营养素的需要
A. 孕早期开始增加
B. 孕中期开始增加
C. 孕晚期开始增加
D. 与孕前相同
E. 能量孕早期开始增加，其余从孕晚期开始增加

正确答案：B。孕中期开始增加